患者，男，45岁，BMI26.5kg/m²，查体发现空腹血糖11.4mmol/L，HbAlc8.8%，诊断为“2型糖尿病”，首选的降糖药物是
A. 格列美脲
B. 阿卡波糖
C. 二甲双胍
D. 比格列酮
E. 胰岛素

正确答案：C。二甲双胍

解析：本题考查二甲双胍。二甲双胍（C对）用于单纯饮食控制不满意的Ⅱ型糖尿病病人，尤其是肥胖和伴高胰岛素血症者，用本药不但有降血糖作用，还可能有减轻体重和高胰岛素血症的效果。该患者BMI为26.5kg/m²，BMI在24～27.9为超重，属于肥胖，可首选二甲双胍。格列美脲（A错）适用于控制饮食、运动疗法及减轻体重均不能满意控制血糖的2型糖尿病。阿卡波糖（B错）配合饮食控制，用于治疗糖尿病，或降低糖耐量低减者的餐后血糖。吡格列酮（D错）用于2型糖尿病的控制与改善。胰岛素（E错）用于糖尿病的治疗，但不适用于低血糖症、胰岛细胞瘤、对胰岛素过敏者。